以下有关一碳单位的描述中，正确的是
A. 主要来源于丝氨酸、甘氨酸、组氨酸和色氨酸
B. 某些氨基酸在分解代谢过程中可以产生含有一个碳原子的基因
C. 是合成嘌呤的原料
D. 是合成嘧啶的原料
E. 以上均正确

正确答案：E。以上均正确

解析：某些氨基酸在分解代谢过程中可以产生含有一个碳原子的基因，称为一碳单位。一碳单位主要来源于丝氨酸、甘氨酸、组氨酸和色氨酸。四氢叶酸是一碳单位的载体。一碳单位的主要生理作用是作为合成嘌呤及嘧啶的原料，故在核酸生物合成中占有重要地位。掌握“个别氨基酸代谢”知识点。